对甲类传染病、乙类传染病中的传染性非典型肺炎新型冠状病毒肺炎肺炭疽患者或疑似患者，报告时限为
A. 应于2小时内将传染病报告卡通过网络报告
B. 城镇应于6小时内，农村应于12小时内通过传染病疫情监测信息系统进行报告
C. 在24小时内通过传染病疫情监测信息系统进行报告
D. 在2小时内向所在地区县级人民政府卫生行政部门报告
E. 在2小时内向本级人民政府报告

正确答案：A。应于2小时内将传染病报告卡通过网络报告